与病原微生物菌（毒）种保藏中心有关的描述，下列哪个不正确
A. 承担集中储存病原微生物菌（毒）种和样本的任务
B. 向实验室提供病原微生物菌（毒）种和样本
C. 对高致病性病原微生物菌（毒）种和样本应当设专库或者专柜单独储存
D. 储存、提供病原微生物菌（毒）种和样本，按规定收取费用
E. 作好病原微生物菌（毒）种和样本进出未储存的记录，建立档案制度

正确答案：D。储存、提供病原微生物菌（毒）种和样本，按规定收取费用